儿童处于非清醒状况，伴有呕吐，宜采用的给药途径为
A. 口服给药
B. 舌下给药
C. 直肠给药
D. 鼻腔给药
E. 吸入给药

正确答案：C。直肠给药

解析：本题考查儿童用药。儿童处于非清醒状况，伴有呕吐，宜采用的给药途径为直肠给药（C对）。直肠给药时，药物从直肠下部吸收，不经过肝脏直接进入体循环，由于患儿处于非清醒状况且伴有呕吐，所以应采用直肠给药。